存在于核酸分子中的碱基有
A. 2种
B. 3种
C. 4种
D. 5种
E. 6种

正确答案：D。5种

解析：碱基可分为嘌呤和嘧啶两类，常见的嘌呤包括腺嘌呤（A）和鸟嘌呤（G），常见的嘧啶包括尿嘧啶（U）、胸腺嘧啶（T）和胞嘧啶（C），共5种（D对）。其中构成DNA的碱基有A、G、C、T，构成RNA的碱基有A、G、C、U。